关于掌深部间隙感染的处理原则，错误的是
A. 切口常选在手背肿胀明显处
B. 抬高患侧上肢
C. 切口不超过手掌远侧横纹
D. 沿掌间隙纵轴切开引流
E. 早期静脉滴注大剂量青霉素

正确答案：A。切口常选在手背肿胀明显处

解析：手掌深部间隙感染抬高患侧，有利于局部血液回流，减轻水肿及充血，避免下垂以减轻疼痛（B对）。掌深部间隙感染多以金黄色葡萄球菌感染为主，对青霉素敏感，因此早期静脉静注大剂量青霉素（E对）可控制感染蔓延。局部肿胀明显时应尽早切开引流，纵行切开（D对）中指与环指间的指蹼掌面（手掌部血管神经及肌腱多呈现纵向走行，作纵行切口引流可减小局部损伤），切口不应超过手掌远侧横纹（手掌远侧横纹下有掌浅动脉弓，因而切口不超过手掌远侧横纹可以避免损伤动脉，影响手指的血供）（C对）。手背皮肤和皮下组织疏松，富有弹性，而手掌皮肤则角化明显、厚而坚韧。故掌面的皮下化脓感染后，其渗出液通过淋巴或反流到手背（P112），因此手掌部脓肿常表现为手背肿胀。但切开引流应当在掌面进行，不可在手背部切开（手掌深部间隙位于手掌屈指肌腱和滑液囊深面的疏松组织间隙，虽然手背肿胀，但病变主要在手掌侧，切口位于手掌侧可以最大限度的减轻渗出液对肌腱的压迫）（A错，为本题正确答案）。